牙周膜的宽度一般为
A. 0.5～1mm
B. 0.15～0.38mm
C. 1.2～2mm
D. 0.5～0.1mm
E. 1～2mm

正确答案：B。0.15～0.38mm

解析：本题考查牙周膜宽度。牙周膜在宽度随年龄及功能状态而异，一般为0.15～0.38mm（B对），以牙根中部支点附近最窄，牙槽嵴顶及根尖孔附近较宽，在X线上牙周膜呈围绕牙根的窄黑线。